患者，女，34岁，受凉后出现发热、流涕、鼻塞等感冒症状，自行服用对乙酰氨基酚及其他复方感冒药。为尽快改善症状，自行加量并增加给药频次。用药2天后出现厌食、恶心和呕吐症状，诊断为对乙酰氨基酚中毒。对乙酰氨基酚有单次给药剂量和每日总剂量的限制，超剂量服用可能损伤的器官或组织是
A. 骨关节
B. 耳蜗神经
C. 肺
D. 心
E. 肝

正确答案：E。肝

解析：本题考查对乙酰氨基酚中毒。对乙酰氨基酚有单次给药剂量和每日总剂量的限制，超剂量服用可能损伤的器官是肝脏（E对）。对乙酰氨基酚作为非处方药物广泛用于退热、止痛，也是复方抗感冒药的重要组成成分之一。对乙酰氨基酚的活性代谢产物N-乙酰-对苯醌亚胺可与内源性谷胱甘肽结合，并直接损伤肝细胞引起肝细胞坏死，因此具有固有性肝毒性。美国、澳大利亚、欧盟等药监部门均发布过对乙酰氨基酚的药物警戒信息，规定了尽可能避免肝损伤发生的对乙酰氨基酚每日给药剂量和单次给药剂量。建议一般日剂量不超过2g/d；用于骨关节疾病止痛时，最大日剂量不超过4g/d。